不寐之病位在
A. 脑
B. 脾
C. 肾
D. 心
E. 肝

正确答案：D。心

解析：心主神明，神安则寐，故不寐的病位主要在心（D对），但亦与肝（E错）、脾（B错）、肾（C错）密切有关。基本病机为阳盛阴衰，阴阳失交，一为阴虚不能纳阳，一为阳盛不得入于阴。